男孩，1岁。近2个月夜间睡眠打鼾，侧卧好转，感冒时加重。病因应首先考虑
A. 腭扁桃体肿大
B. 鼻炎
C. 咽扁桃体肿大
D. 鼻窦炎
E. 喉炎

正确答案：C。咽扁桃体肿大

解析：患儿1岁，睡眠打鼾，侧卧好转，感冒时加重。最可能的诊断为阻塞性睡眠综合征，病因首先考虑咽扁桃体肿大（C对）。咽扁桃体又称腺样体，6个月已发育，位于鼻咽顶部与后壁交界处，严重的腺样体肥大是小儿阻塞性睡眠呼吸暂停综合征的重要原因。鼻炎（B错）、鼻窦炎（D错）主要表现为流涕、打喷嚏。临床常见的扁桃体炎为腭扁桃体炎，幼儿腭扁桃体1岁开始发育，4～10岁发育达高峰，15岁前逐渐缩小。患儿1岁，腭扁桃体未发育，故不选（A错）。喉炎（E错）以犬吠样咳嗽、声嘶、吸气性呼吸困难为临床特征。轻微炎症即可引起喉头狭窄致吸气性呼吸困难（P242）。